调经丸的功能是
A. 理气和血，调经止痛
B. 滋阴清热，固经
C. 补气养血，调经止带
D. 疏肝健脾，养血调经
E. 补血调经，清热利湿

正确答案：A。理气和血，调经止痛